不回流至肝门静脉
A. 胃
B. 小肠
C. 胰
D. 肝
E. 胆囊

正确答案：D。肝

解析：胃（A对）、小肠（B对）、胰（C对）、胆囊（D对）的静脉血为肝门静脉收集，故均回流至肝门静脉。肝脏（D错，为本题正确答案）的静脉血由肝静脉收集，注入下腔静脉，故不回流至肝门静脉。